既是原穴又是八会穴之一的腧穴是
A. 太溪
B. 内关
C. 然谷
D. 太渊
E. 复溜

正确答案：D。太渊

解析：八会穴为：脏会——章门、腑会——中脘、气会——膻中、血会——膈腧、筋会——阳陵泉、脉会——太渊、骨会——大杼、髓会——绝骨。太渊在手太阴肺经，为输穴，肺之原穴，八会穴之脉会（D对）；太溪（A错）在足少阴肾经，为输穴，肾之原穴；内关（B错）在手厥阴心包经，为络穴，八脉交会穴，通于阴维脉；然谷（C错）在足少阴肾经，为荥穴；复溜（E错）在足少阴肾经，为经穴。